阿糖胞苷抗肿瘤作用的机制是抑制
A. IMP生成GMP
B. UTP生成CTP
C. IMP生成AMP
D. CDP生成Dcdp
E. Dump生成dTMP

正确答案：D。CDP生成Dcdp